病原体侵入人体后，临床上不显示出任何症状、体征，但可产生特异性免疫，被称为
A. 潜伏性感染
B. 病原体被清除
C. 隐性感染
D. 显性感染
E. 病原携带状态

正确答案：C。隐性感染

解析：病原体侵入人体后，临床上不显示出任何症状、体征，但可产生特异性免疫，被称为隐性感染（C对）。潜伏性感染（A错）是指病原体感染人体后，寄生在机体中某些部位，由于机体免疫功能足以将病原体局限化而不引起显性感染，但又不足以将病原体清除，病原体便可长期潜伏下来。病原体被清除（B错）是病原体进入人体后，首先可被机体非特异性防御能力所清除。显性感染（D错）是指病原体侵入人体后，不但引起机体发生免疫应答，而且通过病原体本身的作用或机体的变态反应，导致组织损伤，引起病理改变和临床表现。病原携带状态（E错）是指病原体侵入人体后，可以停留在入侵部位或侵入较远的脏器继续生长、繁殖，而人体不出现任何的疾病状态，但能携带并排除病原体，成为传染病流行的传染源。